男孩，生后3天，新生儿听力初筛未通过，进行复筛的时间是在婴儿
A. 42天内
B. 2个月时
C. 3个月时
D. 4个月时
E. 6个月时

正确答案：A。42天内

解析：本题考查对新生儿听力筛查程序。新生儿听力出院前进行初筛，未通过者于42天内（A对BCDE错）进行复筛，仍未通过者转听力检测中心。告知有高危因素的新生儿父母，即使通过筛查仍应结合听力行为观察法，3年内每6个月随访一次。